孕早期妇女感染下列哪种病原体易导致胎儿先天性感染
A. 人乳头瘤病毒
B. 沙眼衣原体
C. 白假丝酵母菌
D. 淋病奈瑟菌
E. 巨细胞病毒

正确答案：E。巨细胞病毒

解析：孕妇巨细胞病毒感染，约15%的胎儿会出现胎儿生长受限、小头畸形、溶血性贫血等，85%出生时无症状，但其中5%～15%远期出现感觉神经性耳聋、精神运动发育迟缓、视力障碍等后遗症，且目前对CMV感染无特效的治疗方法。故孕早期一经确诊为原发感染，应向孕妇及家属交代RV或CMV感染对胎儿和新生儿的可能影响，以决定胎儿的取舍（E对）。人乳头瘤病毒感染（A错）、沙眼衣原体感染（B错）、白假丝酵母菌感染（C错）及淋病奈瑟菌感染（D错）对胎儿多无影响且有有效治疗方法。